男，45岁，风湿性心脏瓣膜病史20年，心房颤动5年。就诊时，心率160次/分，心房颤动，血压100/70mmHg，治疗首选
A. 临时心脏起搏器植入
B. 肾上腺素
C. 直流电复律
D. 毛花甙丙（西地兰）
E. 阿托品

正确答案：D。毛花甙丙（西地兰）

解析：患者有长期风湿性心脏瓣膜病史和房颤病史，就诊时心房颤动诊断明确，心率极快（正常值60～100次/分），血压正常。对于房颤且心率快的患者治疗首选静脉注射洋地黄类药物如毛花甙丙（西地兰）（D对）降低心率，因为房颤患者若心室率快，可使舒张期充盈时间缩短，导致左房压力急剧增加而引起急性肺水肿，同时心排血量减低，而出现一系列缺血缺氧症状。临时心脏起搏器植入（A错）主要用于病态窦房结症状征和高度房室传导阻滞患者。肾上腺素（B错）常用于治疗过敏性休克和心脏骤停。若房颤患者由于心室率增快而出现血流动力学不稳如肺水肿、休克等，应立即行直流电复律（C错）治疗。阿托品（E错）多用于窦性心动过缓、窦房阻滞、房室传导阻滞等缓慢型心律失常。